女，65岁。多食多尿20天体重由55kg降为45kg。血糖7.8，餐后血糖12.4，尿糖（++），尿酮（-）。怎样治疗
A. 饮食疗法
B. 运动疗法
C. 双胍类
D. 磺脲类
E. 胰岛素

正确答案：E。胰岛素

解析：老年患者，起病急，病程短，无明显诱因体重下降明显，血糖升高明显，尿糖（++），尿酮（-），考虑诊断为糖尿病。本例患者体重下降明显，应使用胰岛素（E对）治疗。饮食疗法（A错）、运动疗法（B错）主要用于新诊断的血糖升高不明显的Ⅱ型糖尿病，也是糖尿病的基础治疗，该患者体重下降明显，尚无法鉴别糖尿病类型，故不宜使用饮食及运动治疗。双胍类（C错）是胰岛素增敏剂、磺脲类（D错）是促胰岛素分泌剂，二者均用于诊断明确的T2DM，该患者诊断尚不明确，不应作为首选。